与天然纤维相比，合成纤维织物的优点具体表现在
A. 透气性好
B. 吸汗性能
C. 抑制细菌繁殖
D. 不易引起皮炎
E. 轻便挺括

正确答案：E。轻便挺括

解析：本题考查与天然纤维相比，合成纤维的优点。合成纤维包括锦纶、涤纶、腈纶、丙纶、氯纶、维尼纶等。与天然纤维相比，合成纤维织物的优点具体表现在轻便挺括（E对ABCD错）。